女，19岁。因发热伴头痛、烦躁2天，于1月28日入院。查体：T39℃，BP130/80mmHg，精神差，神志清楚，全身散在瘀点、瘀斑，颈抵抗阳性，Kernig征及Babinski征均阳性。实验室检查：腰穿脑脊液压力240mmH₂O，外观混浊，WBC1200×10⁶/L，蛋白质1.5g/L，糖2.5mmol/L，氯化物100mmol/L。本病蛛网膜切片的病理改变不包括
A. 血管扩张充血
B. 可见大量中性粒细胞
C. 可见大量淋巴细胞和单核细胞
D. 明显水肿
E. 可见纤维素

正确答案：C。可见大量淋巴细胞和单核细胞

解析：青年女性患者，发热伴头痛、烦躁2天，于1月28日入院。查体见全身散在瘀点、瘀斑，以及一系列脑膜刺激症状，脑脊液压力增高（正常值为80-180mmH₂O），白细胞（WBC）数量升高（正常值0-5×10⁶/L），考虑诊断为流行性脑脊髄膜炎，其蛛网膜切片的病理改变有：蛛网膜血管扩张充血（A对），蛛网膜下腔见大量中性粒细胞（B对）、纤维素（E对）渗出和少量淋巴细胞和单核细胞浸润（C错，为本题正确答案），本病脑实质一般不受累，邻近的脑皮质可有轻度水肿（D对）。